止带方的组成成分有
A. 山药、熟地、茯苓、黄柏、知母、丹皮
B. 白芍、熟地、茯苓、黄柏、地骨皮、丹皮
C. 白芍、当归、川芎、莪术、牛膝、丹皮
D. 赤芍、猪苓、茯苓、车前子、牛膝、丹皮
E. 白芍、白术、苍术、车前子、柴胡、陈皮

正确答案：D。赤芍、猪苓、茯苓、车前子、牛膝、丹皮

解析：止带方功能清热利湿止带，由猪苓、茯苓、车前子、泽泻、茵陈、赤芍、丹皮、黄柏、栀子、牛膝组成（D对）。